疑有脐带受压或脐带绕颈，胎儿电子监护时可能出现
A. 早期减速
B. 晚期减速
C. 变异减速
D. 基线胎心率有变异
E. 周期性胎心率加速

正确答案：C。变异减速

解析：脐带受压时胎儿电子监护表现为变异减速（C对）。晚期减速（B错）是胎盘功能不良，胎儿缺氧的表现。早期减速（A错）为宫缩时胎头受压引起，不受孕妇体位或吸氧而改变。基线胎心率有变异（D错）是指胎心率有小的周期性波动，同周期性胎心率加速（E错）均是胎动的正常变化。